必要病因对疾病的作用在时间上必须在疾病发病
A. 之后
B. 同时
C. 之前后
D. 之前
E. 全过程

正确答案：D。之前